患者，女性，50岁，触摸左颊黏膜而引起左颊、左下唇电击样剧痛，持续数秒钟，卡马西平治疗有效。该患者诊断可能为
A. 急性牙髓炎
B. 下颌骨中央性颌骨癌
C. 三叉神经第三支痛
D. 三叉神经第二支痛
E. 三叉神经第二、第三支痛

正确答案：C。三叉神经第三支痛

解析：颊部黏膜和下唇有扳机点，说明诊断为三叉神经第三支（下颌支）疼痛。掌握“三叉神经痛”知识点。